（115～117题共用题干）女，48岁，G2P2。月经周期紊乱伴潮热1年，阴道流血35天，伴头晕、乏力10天。妇科检查见宫颈轻度糜烂，无触血，子宫大小形态正常，双侧附件区未触及异常。超声检查示：子宫内膜厚0.8cm，无血流信号。若诊断成立，首选的治疗是
A. 抗炎治疗
B. 宫颈锥切
C. 广泛性子宫切除术
D. 激素类药物治疗
E. 腹腔镜探查术

正确答案：D。激素类药物治疗

解析：患者围绝经期女性（年龄＞35岁，且功血好发于绝经过渡期），月经周期紊乱伴潮热1年（内分泌紊乱表现），阴道流血35天，伴头晕、乏力10天（由阴道大量出血所导致的贫血症状）。妇科检查见宫颈轻度糜烂，无触血（初步排除宫颈癌变导致的阴道出血），子宫大小形态正常，双侧附件区未触及异常（排除子宫器质性病变）。超声检查示：子宫内膜厚0.8cm，无血流信号。该患者应行诊断性刮宫明确功血诊断，若患者确诊为功血，则优选激素类药物治疗（D对）（P347~P349）。广泛性子宫切除（C错）（P349）适用于各种治疗皆效果不佳的患者，但不是首选治疗方案。宫颈锥切（B错）（P303~P304）是子宫颈上皮内瘤变的治疗方法，不适用于该患者。抗炎治疗（A错）用于妇科感染性疾病的治疗。腹腔镜探查术（E错）多用于诊断不明的腹部疾病。